10个月男孩，母乳喂养，刚开始添加辅食，食欲差，偏食。查体：皮肤弹性尚可，腹部皮下脂肪减少，体重低于同年龄同性别儿童均值减2个标准差。该儿童属于的营养不良类型是
A. 消瘦
B. 体重低下
C. 生长迟缓
D. 轻度
E. 重度

正确答案：B。体重低下

解析：本题考查营养不良的三种类型。该患儿为母乳喂养辅食添加过晚，同时伴有食欲差和偏食，导致能量摄入不足，而出现皮下脂肪减少的营养不良表现，其查体结果为体重低于同年龄同性别儿童均值减2个标准差，符合营养不良分型中的体重低下（B对）。WHO建议将营养不良分为体重低下、生长迟缓、消瘦三种类型（DE错）。因未提供身高结果，故生长迟缓和消瘦（AC错）不予考虑。